等渗性失水多发生于
A. 胃肠液急性丧失
B. 水分摄入不足
C. 大量出汗
D. 渗透性利尿
E. 水分丧失

正确答案：A。胃肠液急性丧失

解析：等渗性失水是水和电解质以血浆正常比例丢失，有效循环血容量减少。见于：经消化道丢失，呕吐、腹泻、胃肠引流（胃肠减压或造瘘等）或肠梗阻。常伴有电解质与酸碱平衡失调，是最常见的原因。经皮肤丢失，大面积烧伤早期或剥脱性皮炎等渗出性皮肤病变。体液积存在组织间隙，如大量放胸水、腹水等（A对）。高渗性失水是由于饮水困难或无淡水供应致摄入不足（B错）。高渗性失水中，由于排出过多，肾外丢失，如高温、剧烈运动、发热、大量出汗、烧伤开放性治疗等经皮肤失水（C错）。高渗性失水，由于排出过多，如糖尿病酮症酸中毒或非酮症高渗性昏迷、鼻饲高蛋白饮食等致溶质性利尿；使用脱水药物或非溶质性利尿（D错）。失水是指体内水分的排出量大于摄入量，导致体液量减少而引起的一组临床症候群（E错）。